常用的吸入麻醉药物除外的是
A. 氧化亚氮
B. 氯胺酮
C. 氟烷
D. 安氟烷
E. 异氟烷

正确答案：B。氯胺酮

解析：吸入麻醉：是指挥发性麻醉药物进呼吸道吸入，通过肺-脑血液循环，抑制中枢神经所产生的麻醉作用。常用的吸入麻醉药物有：乙醚、氟烷、安氟烷、异氟烷、七氟烷和氧化亚氮等。氯胺酮是一具有镇痛作用的静脉全麻药。掌握“全身麻醉”知识点。